女，72岁。腹部绞痛4小时，伴腹胀，无呕吐、发热。下消化道X线钡剂造影见直肠上段钡剂受阻，钡影尖端呈“鸟嘴”形。最可能的诊断是
A. 直肠癌
B. 乙状结肠癌
C. 小肠扭转
D. 乙状结肠扭转
E. 肠套叠

正确答案：D。乙状结肠扭转

解析：女，72岁。腹部绞痛4小时，伴腹胀，无呕吐、发热。下消化道X线钡剂造影见直肠上段钡剂受阻，钡影尖端呈“鸟嘴”形。乙状结肠扭转（D对）多见于乙状结肠冗长、有便秘的老年人，以往可有多次腹痛发作经排气、排便后缓解的病史。病人有腹部持续胀痛，左腹部明显膨胀，可见肠型。腹部压痛及肌紧张不明显。腹部X线平片显示马蹄状巨大的双腔充气肠袢，圆顶向上；立位可见两个液平面。钡剂灌肠X线检查见扭转部位钡剂受阻，钡影尖端呈“鸟嘴”形。